患者，男，50岁。患消渴病5年，症见腰膝酸软、头晕耳鸣骨蒸潮热、盗汗遗精、消渴。中医辨为肾阴虚证，处以六味地黄汤，药用熟地黄24g，酒萸肉12g、山药12g、泽泻9g、牡丹皮9g、茯苓9g。7剂，每日一剂，水煎服。针对其病证，该方的主要药理作用是
A. 解热
B. 抗血栓
C. 祛痰
D. 降血压
E. 降血糖

正确答案：E。降血糖

解析：本题考查的六味地黄汤的药理作用。六味地黄汤的主要药理作用是降血糖（E对）。患者患有糖尿病，使用六味地黄汤，以达到降血糖作用。消渴肾阴亏虚证：【症状】尿频量多，浊如膏脂，腰酸膝软，头晕耳鸣，多梦遗精，乏力，皮肤干燥。舌红少苔，脉细数。【方剂应用】基础方剂为六味地黄丸（熟地黄、山茱萸、山药、泽泻、丹皮、茯苓）加减。解热（A错）、抗血栓（B错）、祛痰（C错）与降血压（D错）与患者的病证无关。